感冒风寒证与时行感冒证的主要区别点是
A. 咳嗽的轻与重
B. 发热的轻与重
C. 恶寒的轻与重
D. 脉数与不数
E. 有无流行性

正确答案：E。有无流行性

解析：感冒风寒证的表现是恶寒重，发热轻，无汗，头痛肢体酸痛，鼻塞声重，喷嚏，时流清涕，喉痒，咳嗽，口不渴或喜热饮，舌苔薄白而润，脉浮或浮紧。时行感冒常有明显的流行性，起病急骤，以全身中毒症状为主，出现畏寒、高热、头痛、头晕全身酸痛、乏力等，呼吸道症状轻微或不明显，可有咽痛、流涕、流泪、咳嗽等。由上可见咳嗽的轻与重（A错）、发热的轻与重（B错）、恶寒的轻与重（C错）、脉数与不数（D错）这四项内容在上述两种疾病中均有类似表现，而有无流行性是感冒风寒证与时行感冒证的主要区别（E对）。